初产妇，25岁。因第二产程延长，行产钳助产，产后阴道流血约800ml，考虑为子宫收缩乏力所致。其主要临床表现应是
A. 胎盘剥离延缓而出血
B. 胎盘娩出后出血无血块
C. 胎盘未娩出时出血不止
D. 胎儿娩出后立即流血不止
E. 胎盘娩出后阵发性出血时多时少

正确答案：E。胎盘娩出后阵发性出血时多时少

解析：青年初产妇，因子宫收缩乏力导致产后出血，主要的临床表现为胎盘娩出后，间断性出血（阵发性出血），即子宫收缩时出血量较少，子宫松弛时出血量较多（时多时少）（E对C错）。胎盘剥离延缓而出血（A错）应考虑为胎盘因素（剥离不全、粘连、植入等）引起的产后出血。胎盘娩出后出血无血块（B错）应考虑为凝血功能障碍所致的产后出血。胎儿娩出后立即流血不止（D错）应考虑为软产道裂伤所致的产后出血。